患者，男，42岁，因非小细胞肺癌使用铂类药物化疗，同时给予止吐药物、升白细胞药物和水化治疗。为预防化疗期间的恶心、呕吐，不宜选择的药物是
A. 托烷司琼
B. 阿托品
C. 阿瑞匹坦
D. 昂丹司琼
E. 甲氧氯普胺

正确答案：B。阿托品

解析：本题考查止吐药的选用。阿托品（B错，为本题正确答案）可用于各种内脏绞痛、全身麻醉前给药、抗休克、解救有机磷酸酯类农药中毒等，不用于止吐。